关于天疱疮的激素治疗特点描述最准确的是
A. 量大、从速
B. 由低量递加
C. 分为起始、控制、减量、维持
D. 可以被中药代替
E. 停药后病情不复发

正确答案：C。分为起始、控制、减量、维持

解析：本题考查天疱疮的激素治疗特点。关于天疱疮的激素治疗特点描述最准确的是分为起始、控制、减量、维持（C对）。天疱疮激素治疗起始阶段量大、从速（A错），在病情达到减量的指征时，应渐减，否则引起药物依赖性，不利于机体恢复。治疗天疱疮病情得不到控制时应低量递加（B错）。起始阶段的糖皮质激素的量视病情而定，在旧病损愈合且无新发病损出现的情况下，达到减量的指征，应渐减，以防病情复发，情况稳定者可予小剂量激素维持，直至停止药物治疗。糖皮质激素对天疱疮明显有效，配合中药可以减轻糖皮质激素的副作用，但不能代替激素治疗（D错）。糖皮质激素治疗往往只能对患者的病情起到很好的抑制作用，而不能彻底治愈该病，停药反弹、愈后复发的现象时有发生（E错）。